缺氧概念是
A. 吸入气中的氧减少
B. 血液中氧含量降低
C. 血液中氧分压降低
D. 血液氧容量降低
E. 供氧不足或用氧障碍

正确答案：E。供氧不足或用氧障碍

解析：缺氧是指组织供氧不足或用氧障碍（E对），导致组织代谢、功能和形态结构异常变化的病理过程。